Somogyi效应的原因是
A. 晚餐碳水化合物摄入过多
B. 夜间曾发生过低血糖
C. 夜间肝脏葡萄糖产生过多
D. 清晨胰岛素作用不足
E. 清晨胰岛素拮抗激素增多

正确答案：B。夜间曾发生过低血糖

解析：采用胰岛素替代治疗后，有时早晨空腹血糖仍然较高，Somogyi效应为其常见原因之一。Somogyi效应是指在夜间曾有低血糖（B对），在睡眠中未被察觉，但导致体内胰岛素拮抗激素分泌增加，继而发生低血糖后的反跳性高血糖。清晨胰岛素拮抗激素增多（E错）为黎明现象的原因。